嘶哑样咳嗽，可见于
A. 急性喉炎
B. 声带疾患
C. 百日咳
D. 胸膜炎
E. 支气管扩张

正确答案：A。急性喉炎

解析：嘶哑样咳嗽可见于急性喉炎（A对），由于声带炎症或肿瘤压迫喉返神经所致。声带疾患（B错）、百日咳（C错）表现为鸡鸣样咳嗽。胸膜炎（D错）患者咳嗽声音低微或无力。支气管扩张（E错）表现为咳嗽伴大量浓痰。